对边缘嵴的解释正确的一项是
A. 前牙舌面窝近远中边缘及后牙（牙合）面边缘的长条形釉质隆起
B. 从牙尖顶端斜向近、远中的嵴
C. 从后牙牙尖顶端伸向（牙合）面中央的细长形釉质隆起
D. 牙冠表面细长形的釉质隆起
E. （牙合）面与轴面相交的长形隆起

正确答案：A。前牙舌面窝近远中边缘及后牙（牙合）面边缘的长条形釉质隆起

解析：边缘嵴：是前牙舌面窝的近远中边缘及后牙（牙合）面边缘的长条形釉质隆起。掌握“牙的萌出、更替及牙体解剖名词、标志”知识点。